麻疹疫苗初种年龄是
A. 2个月
B. 3个月
C. 8个月
D. 1个月
E. 生后2~3天

正确答案：C。8个月

解析：麻疹疫苗初种年龄是8个月（C对）。这种有计划的免疫是根据小儿的免疫特点和传染病发生的情况而制订的免疫程序，通过有计划地使用麻疹疫苗预防接种，可以提高人群的免疫水平、达到控制和消灭传染病的目的。2个月应该接种脊髓灰质炎（A错）。3个月应接种卡介苗（B错）。生后2～3天应接种乙肝卡介苗（E错）。